某病的续发率是指
A. （接触者中发病人数/接触者总人数）✕100%
B. （同等身份的接触者中发病人数/同等身份人数）✕100%
C. （一个潜伏期内接触者中的发病人数/易感接触者总人数）✕100%
D. （一个潜伏期内接触者中的患病人数/易感接触者总人数）✕100%
E. （接触者中的患病人数/接触者总人数）✕100%

正确答案：C。（一个潜伏期内接触者中的发病人数/易感接触者总人数）✕100%